青少年成年期疾病的早期预防，有效的措施是
A. 健康教育
B. 合理膳食
C. 适量运动
D. 疾病监测
E. 采用以上综合措施

正确答案：E。采用以上综合措施